我国的卫生系统组成包括
A. 卫生服务
B. 医疗保障
C. 卫生执法监督
D. 以上均包括
E. 以上均不包括

正确答案：D。以上均包括

解析：我国的卫生系统由卫生服务、医疗保障和卫生执法监督三部分组成。掌握“卫生系统及功能”知识点。